严重甲状腺功能亢进患者的动脉血压变化特点是
A. 主要为收缩压升高
B. 收缩压与舒张压均升高
C. 主要为舒张压升高
D. 收缩压降低，舒张压升高
E. 收缩压升高，舒张压降低

正确答案：E。收缩压升高，舒张压降低

解析：严重甲状腺功能亢进患者由于甲状腺本身产生甲状腺激素过多，对心脏有三个作用：①增强心脏ß受体对儿茶酚胺的敏感性：②直接作用于心肌收缩蛋白，发挥正性肌力作用：③继发于甲状腺激素导致的外周血管扩张，阻力下降，心脏输出量代偿性增加（内科学P687）。上述作用导致心脏每搏输出量增加，心缩期射入主动脉的血量增多，收缩压明显升高，同时甲状腺激素也可以导致外周血管扩张，阻力下降，舒张压降低，故严重甲状腺功能亢进患者的动脉血压变化特点是收缩压升高，舒张压可降低（E对）。